由各种损伤引起的创口，如受伤时间短，细菌未侵入深层组织引起化脓性炎症，也多属
A. 污染创口
B. 无菌创口
C. 感染创口
D. 化脓创口
E. 可疑创口

正确答案：A。污染创口

解析：本题考查污染创口的定义。由各种损伤引起的创口，如受伤时间短，细菌未侵入深层组织引起化脓性炎症，也多属污染创口（A对）。污染创口，指在非无菌条件下发生的创口，如在与口腔、鼻腔相通或口腔内手术的创口（清洁污染创口）。清洁创口，即无菌创口（B错）指未经细菌侵入的创口，多见于外科无菌切口，早期灼伤和某些化学性损伤已经及时处理者，也可以是清洁创口，口腔颌面外科的清洁创口主要是面、颈部手术创口。感染创口（C错），凡细菌已经侵入、繁殖并引起急性炎症、坏死、化脓的创口和在此情况下进行手术的创口，均为感染创口，如脓肿切开引流、颌骨骨髓炎病灶清除术等均为感染创口。临床创口分类为无菌创口、污染创口、感染创口三类（DE错）。